患者，男。45岁，教师。因进食时牙酸疼。检查上4│4牙龈萎缩、无龋、牙颈部楔状缺损、口腔卫生良好。每日刷牙2次，造成楔状缺损的原因中，不必考虑
A. 刷牙方法不正确
B. 牙刷毛太硬
C. 刷牙用力过大
D. 喜进甜食
E. 牙膏中磨擦剂粗糙

正确答案：D。喜进甜食

解析：本题考查楔状缺损。患者，男。45岁，教师。因进食时牙酸疼。检查上4│4牙龈萎缩、无龋、牙颈部楔状缺损、口腔卫生良好。每日刷牙2次，造成楔状缺损的原因中，不必考虑喜进甜食（D错，为本题正确答案）。楔状缺损是由牙颈部解剖结构薄弱、应力疲劳、横刷牙磨损和酸蚀等综合作用在牙颈部形成的楔形缺损。刷牙不当（A对）与楔状缺损有密切关系：①不刷牙的人较少发生楔状缺损，横向刷牙者，常有严重的棋状缺损；②楔状缺损不发生在牙齿的舌面；③唇向错位的牙楔状缺损常比较严重；④楔状缺损的牙常伴有牙龈退缩，牙根暴露。研究还发现，楔状缺损的严重程度与牙刷刷毛的硬度（B对）、牙膏中颗粒的直径（E对）、刷牙的力度（C对）呈正相关关系。